下列项目中，属于药品标准中安全性检查项目的有
A. 无菌
B. 细菌内毒素
C. 重量差异
D. 崩解时限
E. 溶出度

正确答案：A、B。无菌；细菌内毒素

解析：本题考查药品标准检查项下的内容。下列项目中，属于药品标准中安全性检查项目的有无菌（A对）、细菌内毒素（B对）。药品安全性检查的项目有“异常毒性”、“无菌”、“细菌内毒素”、“热原”、“升压物质”、“降压物质”及“过敏反应”等。均一性检查主要是检查制剂的均匀度，如片剂等固体制剂的“重量差异”（C错）、“含量均匀度检查”。有效性检查的项目通常为和药物的疗效有关、但不能通过其分析有效控制的项目，如片剂通常需要检查“崩解时限”（D错）或测定“溶出度”（E错）等。